下列各项，不属尿路感染中医证型的是
A. 膀胱湿热
B. 肝胆郁热
C. 脾肾亏虚，湿热屡犯
D. 心火亢盛，热移小肠
E. 肾阴不足，湿热留恋

正确答案：D。心火亢盛，热移小肠

解析：心火亢盛，热移小肠为小肠实热证（D错，为本题正确答案）。尿路感染主要与湿热毒邪蕴结膀胱及脏腑功能失调有关，包括膀胱湿热证，肝胆郁热证，脾肾亏虚，湿热屡犯证，肾阴不足，湿热留恋证（ABCE对）。